男，5岁。眼距宽，眼裂小，鼻梁低平，舌常伸出口外，流涎多，有通贯掌，合并先天性心脏病，最有确诊意义的检查为
A. 听力测定
B. 胸部X线检查
C. 肝功能测定
D. 染色体检查
E. 腹部B型超声检查

正确答案：D。染色体检查

解析：患儿有眼距宽、眼裂小、鼻梁低平、舌常伸出口外、流涎多的特殊面容，并有典型症状通贯掌，应诊断为唐氏综合征。唐氏综合征，又称21-三体综合征，是人类最早被确定的染色体病，因此最有确诊意义的检查为染色体检查（D对）。